外科内治三原则中的“补法”适用于
A. 一切肿疡初期
B. 肿疡疮形已成者
C. 溃疡中期，正虚毒盛者
D. 溃疡后期，疮口难敛者
E. 外科非化脓性肿块性疾病

正确答案：D。溃疡后期，疮口难敛者

解析：补法以补虚扶正为主，助养新肉，促疮口愈合。包括补气、养血、温阳、滋阴、调补脾胃、滋补肝肾等。多用于疮疡后期，毒邪已净，正气未复，疮口难收者。但如毒邪未净时则应慎用补法，以免留邪为患（D对）。初期宜用消法，使初起的肿疡得以消散，以祛邪为主，并针对引起感染的不同原因和表现特点具体运用清热解毒、活血化瘀、软坚散结、祛风解表、理气祛痰、清利湿热、通里攻下等治法（A错）。若疮形已成，则不可用内消之法，以免毒收不收，气血受损；或脓毒内蓄，侵蚀好肉，甚至腐烂筋骨，反使溃后难敛，不易速愈。故《外科启玄》云：“如形症已成，不可此法也。”（B错）。中期宜用托法以扶助正气，托毒外出，以防毒邪内陷，常扶正祛邪并重。包括透托法和补托法，透托法适用于疮疡酿脓尚未成熟，毒盛而正气不虚者，常用方剂为透脓散；补托法适用于肿疡毒势方盛，正气已虚，不能托毒外达，疮形平塌，肿势散漫，难溃难腐的虚中夹实之证（C错）。消法是运用不同的治疗方法和方药，使初起的肿疡邪毒不致结聚成脓而得到消散的治法，是一切肿疡初起的治法总则。此法适用于尚未成脓的初期肿疡和非化脓性肿块性疾病以及各种皮肤疾病（E错）。